女，27岁，妊娠分娩胎儿死亡，3天后出现精神异常，并出现黄疸，尿检中有蛋白，下列检查对诊断帮助最大的是
A. 脑电图
B. 肾功能
C. 血胆红素
D. 血常规
E. 血清抗核抗体

正确答案：C。血胆红素

解析：该患者出现黄疸，尿中有蛋白，说明血中有胆红素，现在应查是直接胆红素还是间接胆红素，故检查对诊断帮助最大的是血胆红素（C对）。脑电图（A错）主要用于监测脑电波，对黄疸帮助不大。肾功能（B错）检查主要检测肌酐、尿素等反映肾功能的指标。血常规（D错）主要是检查红细胞、白细胞、血小板等血液常规。血清抗核抗体（八版内科学799）（E错）主要用于检测系统性红斑狼疮等风湿性疾病。